下列心律正常、无心力衰竭趋势的心脏病人中，手术耐受力最差的是
A. 冠心病病人
B. 急性心肌炎病人
C. 风湿性心脏病病人
D. 高血压性心脏病病人
E. 房室传导阻滞病人

正确答案：B。急性心肌炎病人

解析：心脏病患者的手术耐力分为三类（五版外科学P154）：①手术耐力良好者：非紫绀型先心病、风心病（C错）、高心病（D错）、心律正常无心衰趋势者；②手术耐力较差者：冠心病（A错）、房室传导阻滞（E错）；③手术耐力很差者：急性心肌炎（B对）、急性心梗、心力衰竭。